肾上腺
A. 附于肾的内侧
B. 属于腹膜内位器官
C. 左侧呈半月形，右侧呈三角形
D. 可随下垂的肾下降
E. 包在肾纤维囊内

正确答案：C。左侧呈半月形，右侧呈三角形

解析：肾上腺位于肾的上方（A错) , 质软，淡黄色，与肾共同包于肾筋膜内（E错）左侧呈半月形，右侧呈三角形（C对），重6. 8 - 7. 2g。